正确描述软腭的是
A. 呈水平位
B. 由软骨、肌腱和黏膜构成
C. 为腭的前1/3
D. 为腭的后1/3
E. 又称腭垂

正确答案：D。为腭的后1/3

解析：软腭前部为水平位，后部斜向后下(A错)，由腭腱膜、腭肌、腭腺、血管、神经和黏膜构成(B错)，为腭的后1/3(C错D对)，腭帆游离缘中部垂向下的突起为腭垂(E错)。